最易受外界不良因素影响而发生夭折、先天畸形或遗传性疾病的胎龄为
A. 16周内
B. 20周内
C. 28周内
D. 12周内
E. 24周内

正确答案：D。12周内

解析：最易受外界不良因素影响而发生夭折、先天畸形或遗传性疾病的时期为妊娠早期，即13周内（D对）。14～27周末为中期妊娠，该期应注意妊娠早期各种影响因素对胎儿是否有损伤，同时预防妊娠晚期并发症等。